男性，24岁，因气促1周就诊，查体颈静脉怒张，血压90/75mmHg，心界向两侧扩大，心率120次/分，律齐，心音遥远，肝肋下3指，移动性浊音（-），最可能的诊断是
A. 冠心病
B. 肝硬化
C. 急性纤维蛋白性心包炎
D. 急性渗出性心包炎
E. 肺栓塞

正确答案：D。急性渗出性心包炎

解析：患者为青年男性，有气促症状，查体示颈静脉怒张，脉压（收缩压与舒张压之差，正常值为30～40mmHg）变小，心界向两侧扩大，心音遥远（心包积液常见体征），肝肋下3横指（提示肝肿大），综合患者的病史、典型体征，该患者最可能的诊断是急性渗出性心包炎（D对）。冠心病（P218）（A错）多见于老年人，主要表现为与劳力运动有关的心前区疼痛。肝硬化（P406）（B错）患者常有严重肝功能减退和门静脉高压症，可出现食欲减退、营养不良、黄疸、大量腹水等症状。急性纤维蛋白性心包炎（C错）时心包积液量较少，此时一般无心界扩大和心音遥远等症状，因此并非本题最佳答案。肺栓塞（E错）常表现为突然出现的呼吸困难、胸痛、咯血甚至晕厥等症状。